适用于肥胖及单用饮食控制无效者的药物是
A. 阿卡波糖
B. 二甲双胍
C. 格列本脲
D. 胰岛素
E. 氯磺丙脲

正确答案：B。二甲双胍

解析：本题考查二甲双胍。二甲双胍（B对）为双胍类降糖药，主要通过抑制肠道吸收葡萄糖，促进外周组织利用葡萄糖，主要用于单纯饮食控制及体育锻炼治疗无效的2型糖尿病，特别是肥胖的2型糖尿病。阿卡波糖（A错）为α-葡萄糖苷酶抑制剂。格列本脲（C错）为磺酰脲类促胰岛素分泌药，主要用于轻、中度2型糖尿病的治疗。胰岛素（D错）可直接增加葡萄糖的利用，降低血糖。氯磺丙脲（E错）为促胰岛素分泌剂，适用于单用饮食控制疗效不满意的轻、中度Ⅱ型糖尿病。